酸水溶解、氯仿萃取是哪类生物碱
A. 非酚性强碱性生物碱
B. 酚性强碱性生物碱
C. 季胺性生物碱
D. 水溶性生物碱
E. 弱碱性生物碱

正确答案：E。弱碱性生物碱

解析：本题考查的是生物碱的分离方法。酸水溶解、氯仿萃取是哪类生物碱弱碱性生物碱（E对）。基于生物碱类别不同的分离方法，总生物碱以酸水溶解，滤过得到酸水溶液。在经过氯仿萃取得到弱碱性生物碱。